不耐热、不耐湿以及贵重物品可选择
A. 压力蒸汽灭菌法
B. 干热灭菌
C. 低温蒸汽甲醛气体消毒、灭菌
D. 浸泡灭菌
E. 真空高温高压灭菌法

正确答案：C。低温蒸汽甲醛气体消毒、灭菌

解析：根据消毒物品的性质选择消毒方法：①耐高温、耐湿度的物品和器材，应首选压力蒸汽灭菌；耐高温的玻璃器材、油剂类和干粉类等可选用干热灭菌。②不耐热、不耐湿以及贵重物品，可选择环氧乙烷或低温蒸汽甲醛气体消毒、灭菌。③器械在浸泡灭菌时，应选择对金属基本无腐蚀性的消毒剂。掌握“口腔器械的消毒与灭菌及医疗废物处理”知识点。